女，61岁。半年内出现3次突然不能言语，每次持续30分钟左右，第3次伴右侧肢体麻木，既往有房颤病史，神经系统检查正常，最可能的诊断是
A. 癫痫小发作
B. 偏头痛
C. 颈椎病
D. 短暂性脑缺血发作
E. 顶叶肿瘤

正确答案：D。短暂性脑缺血发作

解析：患者老年女性，半年内出现3次突然不能言语，每次持续30分钟左右，第3次伴右侧肢体麻木，既往有房颤病史，神经系统检查正常。可见患者发病比较稀疏，每次持续时间较长，又患者有房颤病史，应考虑为房颤产生的附壁血栓脱落导致的椎-基底动脉系统TIA（短暂性脑缺血发作）（D对）。癫痫小发作（A错）即失神发作，典型表现为突发短暂的5-10秒意识丧失和症状进行的动作中断，双眼茫然呼之不应（P303）。偏头痛（B错）表现为明显的额颞部或眶后搏动性头痛以及恶心、呕吐、畏光、畏声等伴随症状（P158）。颈椎病（C错）主要表现为颈肩痛、头晕头痛、上肢麻木、肌肉萎缩、严重者双下肢痉挛、行走困难，甚至四肢麻痹，大小便障碍，出现瘫痪。顶叶肿瘤（E错）主要产生皮质性感觉障碍、失用和失认症等，一般表现为慢性进行性进展，症状会加重，神经系统检查有异常。